创口愈合的过程不包括
A. 局部炎症反应
B. 细胞增殖
C. 结缔组织形成
D. 感染
E. 伤口收缩和伤口改建

正确答案：D。感染

解析：创口愈合一般经历局部炎症反应、细胞增殖、结缔组织形成、伤口收缩和伤口改建等过程。掌握“口外创口处理”知识点。